可作为热性哮喘辨证依据的是
A. 痰稠色黄，舌红苔黄
B. 面色苍白，脉细无力
C. 面色白，腰膝痠软
D. 食少便溏，舌淡脉缓
E. 痰稀色白，舌苔白腻

正确答案：A。痰稠色黄，舌红苔黄

解析：热哮证辩证依据哮证和热象；气粗息涌，咳呛阵作，喉中哮鸣，为哮证的典型表现；胸高胁胀，烦闷不安，汗出，口渴喜饮，面赤口苦，为热证的表现；咳痰色白或色黄，黏浊稠厚，咳吐不利，不恶寒，舌质红，苔黄腻，可作为热性哮喘的辩证依据（A对）。面色苍白，脉细无力可见于哮喘缓解期肾虚证（B错）。面色白，腰膝痠软可见于哮喘缓解期肾虚证（C错）。食少便溏，舌淡脉缓见于哮喘缓解期脾虚证（D错）。痰稀色白，舌苔白腻见于发作期冷哮证（E错）。